阳虚证宜采用的治法有
A. 阴病治阳
B. 阳病治阴
C. 阴中求阳
D. 阳中求阴
E. 益阳滋阴

正确答案：A、C。阴病治阳；阴中求阳

解析：本题考查补其不足的含义和临床应用。阳虚证，可用的治法有阴病治阳（A对）、阴中求阳（C对）。补其不足的含义和临床应用：对于阴阳偏衰，即阴液或阳气的一方虚损不足的病证，如阴虚、阳虚或阴阳两虚等，治当采用“补其不足”“虚者补之”之法。根据阴阳对立互制的理论，采用阴病治阳、阳病治阴治法；根据阴阳互根互济的理论，采用阴中求阳、阳中求阴治法。1.阴病治阳：针对阳虚而阳不制阴，阴气偏亢的虚寒证，应采用助阳以抑阴的治法，又称为“益火之源，以消阴翳”。2.阳病治阴（B错）：针对阴虚而阴不制阳，阳气偏亢的虚热证，应采用滋阴以制阳的治法，又称为“壮水之主，以制阳光”。3.阴中求阳：在补阳时可适当配用补阴药的治法，使阳得阴助而生化无穷。4.阳中求阴（D错）：在补阴时可适当配用补阳药的治法，使阴得阳生而泉源不竭。